某女，49岁，经血非时而下，出血量多，淋沥不尽，色淡质稀，两目干涩，腰膝酸软，面色晦暗，舌淡暗，脉沉弱。根据临床表现，该患者的中医辨证是
A. 气血两虚
B. 肝肾不足
C. 脾不统血
D. 瘀血阻络
E. 阴虚火旺

正确答案：B。肝肾不足

解析：本题考查的是崩漏的辨证论治。经血非时而下，出血量多，淋沥不尽，色淡质稀，两目干涩，腰膝酸软，面色晦暗，舌淡暗，脉沉弱。根据临床表现，该患者的中医辨证是肝肾不足（B对）。崩漏是月经的周期、经期、经量发生严重失常的病证，经血非时暴下不止或不尽，前者谓之崩中，后者谓之漏下。崩与漏出血情况虽不同，然二者常相互转化，交替出现，且其病因病机基本相同，故概称崩漏。西医学中的无排卵性功能性子宫出血，可参照本证进行辨证治疗。（一）气血两虚（A错）证：【症状】出血量多或淋沥不尽，血色淡薄，面色无华，气短懒言，食欲不振，便溏。舌质淡，苔薄白湿润，脉细弱。（二）脾不统血（C错）证：【症状】出血量多，日久而止，气短神疲，面色㿠白，或面浮肢肿，手足不温，或饮食不佳，大便溏。舌质淡，苔薄白，脉弱或沉弱。（三）肝肾不足证：【症状】月经非时而下，或月经先期，经期延长，经血暗红，量少而淋沥不畅，咽干颧红，心烦潮热，腰膝酸软。舌红苔少或光剥苔，脉沉细无力。（四）瘀血阻络（D错）证：【症状】经血非时而下，量时多时少，时出时止，或淋沥不断，或停闭数月又突然崩中，继之漏下，经色暗有血块；舌质紫暗或尖边有瘀点，脉弦细或涩。阴虚火旺（E错）为绝经前后诸症的辨证论治。绝经前后诸症阴虚火旺证：【症状】绝经前后，月经紊乱，心烦易怒，懊恼不安，坐卧不宁，哭笑无常，夜卧多梦善惊，口干渴饮，尿黄便燥。舌质红，苔薄黄，脉弦细而数。